男，35岁，诊断为酒精所致精神障碍。入院后感到身体表面有许多虫子在皮肤上爬行，瘙痒难忍，焦躁不安，此症状最可能是
A. 幻触
B. 本体幻觉
C. 感觉过敏
D. 感觉倒错
E. 错觉

正确答案：A。幻触

解析：青年患者，诊断为酒精所致精神障碍。入院后感到身体表面有许多虫子在皮肤上爬行，瘙痒难忍，焦躁不安，此症状最可能是幻触（A对），是指在没有任何刺激时，感到皮肤上有某种异常的感觉。本体幻觉（B错）是患者身体内部某一部位或某一脏器虚幻的知觉体验。如感到骨头里的虫爬感、血管的拉扯感、肠道的扭转感、肺叶的被挤压感等。感觉过敏（C错）是对刺激的感受性增高，感觉阈值降低，表现为对外界一般强度的刺激产生强烈的感觉体验，如感到阳光特别刺眼、轻柔的音乐特别刺耳、轻微的触摸皮肤感到疼痛难忍等。感觉倒错（D错）是对外界刺激产生了和正常人性质不同的或者是截然相反的异常的感觉,比方说热的刺激产生了凉的感觉。错觉（E对）是对客观事物歪曲的知觉。